妊娠12周，阴道流血7天，体温38℃，白细胞12×109/L，首先处理方法是
A. 立即刮宫后再给抗生素
B. 立即给抗生素后再刮宫
C. 观察阴道出血时再刮宫
D. 立即给麦角注射
E. 保胎治疗

正确答案：B。立即给抗生素后再刮宫

解析：阴道流血7天，体温高考虑流产感染，治疗原则是积极控制感染，尽快清除宫内残留物。掌握“自然流产”知识点。